最容易引起子宫内膜增生的肿瘤的是
A. 浆液性瘤
B. 畸胎瘤
C. 卵黄囊瘤
D. 颗粒细胞瘤
E. 纤维瘤

正确答案：D。颗粒细胞瘤

解析：卵巢肿瘤分为14大类，其中主要组织学类型为上皮性肿瘤、生殖细胞肿瘤、性索－间质肿瘤及转移性肿瘤。浆液性瘤（A错）属于上皮性肿瘤。畸胎瘤（B错）（P320）、卵黄囊瘤（C错）（P321）属于生殖细胞肿瘤。颗粒细胞瘤（D对）（P321）、纤维瘤（E错）（P322）属于性索－间质肿瘤。颗粒细胞瘤常合并子宫内膜增生，甚至子宫内膜癌。因此最容易引起子宫内膜增生的肿瘤的是颗粒细胞瘤（D对）。